欲用95%乙醇和蒸馏水配制70%乙醇1000ml，所取95%乙醇体积约为
A. 500ml
B. 665ml
C. 700ml
D. 737ml
E. 889ml

正确答案：D。737ml

解析：本题考查稀释计算。稀释前后溶质乙醇的量不变，1000ml的70%乙醇需要乙醇700ml，则需选用的95%乙醇体积为700÷95%＝736.8ml≈737ml（D对）。